糖皮质激素适宜给药的时间是
A. 清晨
B. 餐前
C. 餐中
D. 餐后
E. 睡前

正确答案：A。清晨

解析：本题考查药品服用的适宜时间。糖皮质激素血药浓度峰值一般在清晨（A对）7～8时，谷值在午夜0时，故适宜在清晨给药。适宜餐前（B错）服用的药物有胃黏膜保护剂、收敛药、促胃动力药等。适宜餐中（C错）服用的药物有助消化药、肝胆辅助用药、减肥药等。适宜餐后（D错）服用的药物有非甾体抗炎药、维生素、组胺H₂受体阻断剂。适宜睡前（E错）服用的药物：催眠药、平喘药、调节血脂药、碳酸钙等。